Ⅱ型呼吸衰竭的氧疗原则是
A. 间歇低浓度给氧
B. 慢速高浓度给氧:
C. 正压低浓度给氧
D. 持续低流量低浓度给氧
E. 持续高流量高浓度给氧

正确答案：D。持续低流量低浓度给氧

解析：Ⅱ型呼吸衰竭的氧疗原则是持续低流量低浓度给氧（D对）。